某地区种植的蔬菜中硝酸盐和亚硝酸盐的含量较高，为降低其含量可使用
A. 氮肥
B. 磷肥
C. 钾肥
D. 钼肥
E. 草肥

正确答案：D。钼肥